患者发作头痛，以前额为甚，面红，牙痛，便干，舌红苔黄，脉弦。处方用药加用白芷，除治疗效应外，其“引经报使”作用于
A. 少阳经
B. 太阳经
C. 阳明经
D. 少阴经
E. 厥阴经

正确答案：C。阳明经

解析：因为患者发作头痛，以前额为甚，而足阳明经行于额部，所以引经药要作用于阳明经（C对）。少阳头痛在头之两侧，并连及于耳（A错）。太阳头痛，在头后部，下连于项（B错）。厥阴头痛在巅顶部位，或连目系（E错）。